男，40岁。咽痛、咳嗽1个月余，半个月前多次肌注青霉素治疗好转，但近5天来发生寒战发热，体温达39.2~40℃，伴谵妄，同时右臀注药物处胀痛较剧。查体：呼吸正常，血压96/58mmHg，咽部充血，扁桃体稍肿大，未及浅表肿大淋巴结，心律齐，肺部呼吸音粗糙，无啰音，腹平软，无压痛，肝、脾未触及，右臀部肿胀，皮肤发光，压痛明显。白细胞16x10⁹/L，有核左移。最可能的感染原发灶是在
A. 肺炎
B. 腹膜炎
C. 扁桃体炎
D. 臀蜂窝织炎
E. 淋巴结炎

正确答案：D。臀蜂窝织炎